急性期痛风患者嘌呤摄入量应低于
A. 50mg/d
B. 100mg/d
C. 150mg/d
D. 200mg/d
E. 250mg/d

正确答案：C。150mg/d

解析：本题考查急性期痛风患者嘌呤摄入量。急性期痛风患者嘌呤摄入量应低于150mg/d（C对ABDE错）。